体内可以代谢成吗啡，具有成瘾性的镇咳药是
A. 可待因
B. 布洛芬
C. 对乙酰氨基酚
D. 乙酰半胱氨酸
E. 羧甲司坦

正确答案：A。可待因

解析：本题考查镇咳药可待因。可待因（A对）是吗啡的3位甲醚衍生物，在肝脏代谢，代谢后约8%生成吗啡，产生成瘾性。可待因可直接抑制延脑的咳嗽中枢，镇咳作用强。布洛芬（B错）是非甾体类解热镇痛药；对乙酰氨基酚（C错）为苯胺类解热镇痛药；乙酰半胱氨酸（D错）为黏液溶解剂，具有较强的黏痰溶解作用。羧甲司坦（E错）是一种化痰药物。